下列癥瘕的定义，正确的是
A. 癥多为恶性，瘕多为良性
B. 癥有形可征，固定不移，痛无定处
C. 瘕聚散无常，推之可移，痛有定处
D. 妇人下腹结块，或痛，或胀，或满
E. 癥属气病，瘕属血病

正确答案：D。妇人下腹结块，或痛，或胀，或满

解析：癥瘕所指的妇科肿瘤以良性居多，不能根据癥或瘕来判断良性还是恶性（A错）。癥者有形可征，固定不移，痛有定处（B错）。瘕者聚散无常，推之可移，痛无定处（C错）。妇人下腹结块，伴有或胀、或痛、或满、或异常出血者，称为癥瘕（D对）。癥属血病，瘕属气病（E错）。